下列哪项非环境中易引起持续性蓄积危害的污染物
A. DDT
B. 多氯联苯
C. 氮氧化物
D. 铅
E. 镉

正确答案：C。氮氧化物

解析：本题考查环境中易引起持续性蓄积危害的污染物。持续性蓄积危害的污染物主要有两类，一类是铅（D对）、镉（E对）、汞等重金属及其化合物，另一类是脂溶性强、不易降解的有机化合物，如DDT（A对）、多氯联苯（B对），这类化合物能在环境中长期残留持久存在，在生物体内持续性蓄积，被称为持久性有机污染物。氮氧化物（C错，为本题正确答案）不引起持续性蓄积危害。